无牙颌患者种植体周围的菌斑组成中含有以下哪种
A. 螺旋体
B. 牙龈卟啉单菌
C. 中间普氏菌
D. 产黑色素厌氧菌
E. 乳酸杆菌

正确答案：C。中间普氏菌

解析：部分缺牙患者与无牙颌患者的种植体周围菌斑组成有所不同。部分缺牙患者菌斑中常见牙龈卟啉单胞菌（Pg）、螺旋体等牙周致病菌。而无牙颌患者种植体周围的菌斑组成更接近健康牙周的菌斑，主要含中间普氏菌（Pi）、具核梭杆菌（Fn）等机会致病菌，而很少发现牙龈卟啉单菌（Pg）和螺旋体。掌握“种植体周围组织疾病”知识点。